关于雌激素的作用，下列说法正确的是
A. 促进水纳排泄
B. 抑制输卵管蠕动
C. 使阴道上皮角化现象消失
D. 使宫颈粘液分泌增多而稀薄
E. 对下丘脑和垂体仅产生负反馈作用

正确答案：D。使宫颈粘液分泌增多而稀薄

解析：雌激素的生理作用使宫颈口松弛、扩张；宫颈黏液分泌增加，性状变稀薄，易拉成丝状。掌握“女性生殖系统生理”知识点。